初孕妇，24岁，妊娠39周。腹痛2天，加剧1小时。查体：BP130/90mmHg，心率106次/分。下腹拒按，阴道口可见胎儿上肢，胎心音消失。导尿呈淡红色。首选的处理措施是
A. 行毁胎术
B. 内倒转后臀牵引
C. 行胎头吸引术
D. 立即剖宫产
E. 行产钳助产术

正确答案：D。立即剖宫产

解析：青年初产妇，腹痛2天，加剧1小时。查体：BP130/90mmHg，心率106次/分（＞100次/分，为心动过速）。下腹拒按（先兆子宫破裂的产妇烦躁不安，呼吸、心率过快，下腹剧痛难忍），阴道口可见胎儿上肢（为忽略性肩先露，可造成梗阻性难产，是先兆子宫破裂的高危因素），胎心音消失（因宫缩过强、过频，胎儿触不清，胎心率加快或减慢或听不清）。导尿呈淡红色（膀胱受压充血，出现排尿困难及血尿），诊断为忽略性肩先露引起的先兆子宫破裂。首先处理措施是立即剖宫产（D对）。由于胎儿尚可存活，因此行毁胎术（A错）不恰当。内倒转后臀牵引（P205）（B错）适用于臀先露。行胎头吸引术（C错）与行产钳助产术（E错）适用于头先露，而本例为肩先露。